血红蛋白的氧解离曲线是
A. 氢键、盐键、疏水键和二硫键
B. “S”型
C. 加热
D. 双曲线
E. α-螺旋

正确答案：B。“S”型

解析：别构酶与它们的底物结合、Hb与O2结合均呈特征性“S”型曲线。掌握“蛋白质结构与功能关系”知识点。